葛根的主要化学成分是
A. 大豆素
B. 白果内酯
C. 牡荆素
D. 芦丁
E. 橙皮苷

正确答案：A。大豆素

解析：本题考查的是葛根的主要化学成分。葛根的主要化学成分是大豆素（A对）。葛根含异黄酮类化合物，主要成分有大豆素、大豆苷、大豆素-7，4'-二葡萄糖苷及葛根素、葛根素-7-木糖苷。《中国药典》以葛根素为指标成分进行含量测定，要求含葛根素不得少于2.4%。白果内酯（B错）为银杏叶的质量控制成分之一银杏叶中的黄酮类化合物有黄酮、黄酮醇及其苷类、双黄酮和儿茶素类等。《中国药典》以总黄酮醇苷和萜类内酯为指标成分进行含量测定。要求总黄酮醇苷不少于0.4%，对照品采用槲皮素、山柰素和异鼠李素；要求萜类内酯不少于0.25%，对照品采用银杏内酯A、银杏内酯B、银杏内酯C和白果内酯。牡荆素（C错）为芹菜素的8-位碳葡萄糖苷。芦丁（D错）为槐花的质量控制成分。槐花中主要成分及其化学结构：槐米含有芦丁，槲皮素，皂苷等。其中，芦丁是有效成分。槐米中芦丁的含量高达23.5%，槐花开放后降至13.0%。《中国药典》以总黄酮和芦丁为指标成分对槐米或槐花进行含量测定。要求槐花总黄酮（以芦丁计）不少于8.0%，槐米总黄酮不少于20.0%，对照品采用芦丁；要求芦丁含量，槐花不得少于6.0%，槐米不得少于15.0%。橙皮苷（E错）为陈皮的质量控制成分。陈皮中除含挥发油外，还含有多种黄酮类化合物，其中橙皮苷多制成甲基橙皮苷供药用，是治疗冠心病药物“脉通”的重要原料之一。《中国药典》以橙皮苷为指标成分对陈皮进行含量测定。要求陈皮中橙皮苷含量不得少于3.5%；广陈皮中橙皮苷含量不得少于2.0%，对广陈皮，另外要求测定川陈皮素和橘皮素的总量，总量不得少于0.42%。